里证，是指病变的部位在
A. 皮肤
B. 气分
C. 脏腑
D. 血分
E. 骨髓

正确答案：B、C、D、E。气分；脏腑；血分；骨髓

解析：本题考查的是里证的临床表现及辨证要点。里证，是指病变的部位在气分（B对）、脏腑（C对）、血分（D对）、骨髓（E对）。里证，指的是病位深在于内（脏腑、气血、骨髓等）的一类证候，是与表证相对而言的。概括地说，凡非表证的一切证候皆属里证。以无新起恶寒发热并见为里证的辨证要点。病变部位在皮肤（A错）的是表证。表证，指的是病位浅在肌肤的一类证候。一般是指六淫之邪从皮毛、口鼻侵入人体而引起的外感病初起阶段。其临床表现以发热恶寒，或恶风，舌苔薄白，脉浮为主。常兼见头身疼痛、鼻塞、咳嗽等症状。以起病急、病程短、有发热恶寒的症状为辨证要点。